女，45岁。发热、胸闷2周，伴膝关节疼痛不适，胸部X线片示右侧中等量胸腔积液，胸水常规检查示有核细胞数1200×10⁴/L，单核细胞0.87，多核细胞0.10，间皮细胞0.03，LDH320U/L，ADA54U/L，总蛋白45g/L。该患者胸腔积液最可能的诊断是
A. 结核性胸腔积液
B. 类肺炎性胸腔积液
C. 淋巴瘤所致胸腔积液
D. 结缔组织病所致胸腔积液
E. 恶性胸腔积液

正确答案：A。结核性胸腔积液

解析：患者胸水总蛋白45g/L（为渗出液），单核细胞多，多核细胞少（以淋巴单核细胞为主，中性粒细胞少），LDH320U/L，ADA54U/L，该患者胸腔积液最可能的诊断是结核性胸腔积液（A对）。类肺炎性胸腔积液（B错）常有中性粒细胞增多。恶性胸腔积液（CE错）常有LDH>500U/L，ADA <45U/L。